痛经寒湿凝滞证的治法是
A. 理气化瘀止痛
B. 温经暖宫止痛
C. 温经活血，调经止痛
D. 温经除湿，调经止痛
E. 温经化痰，利湿止痛

正确答案：D。温经除湿，调经止痛

解析：寒凝胞中分为阳虚内寒与寒湿凝滞，寒湿凝滞证为外感寒湿之邪，寒湿凝滞，阻滞冲任、胞宫，不通则痛，治疗宜祛寒除湿，化瘀止痛（D对）。肝气郁结，瘀阻冲任，不通则痛，治疗当选理气化瘀止痛（A错）。阳气虚弱，寒气内生，冲任、胞宫失煦，虚寒滞血，不通则痛，治疗当温经暖宫止痛（B错）。寒邪凝滞子宫冲任，血行不畅，不通则痛，治疗当用温经活血，调经止痛（C错）。痰湿凝滞，治疗宜温经化痰，利湿止痛（E错）。